治疗小儿疳积、百日咳，应首选
A. 足三里
B. 四缝
C. 合谷
D. 曲池
E. 大椎

正确答案：B。四缝

解析：四缝定位在第2至第5指掌侧，近端指间关节的中央，一手4穴，左右共8穴，常用治小儿疳积、百日咳（B对）。足三里可治胃肠疾病，但不可治百日咳（A错）。合谷主治：①头痛、目赤肿痛、齿痛、耳聋等头面五官诸疾；②发热恶寒等外感病证，热病无汗或多汗；③经闭、滞产等妇产科病证（C错）。曲池可治上肢病、热性疾病以及皮肤、外科等疾病，但非治疳积、百日咳的首选（D错）。大椎可治：①热病、疟疾、恶寒发热等外感病证；②骨蒸潮热；③癫狂痫证、小儿惊风等神志病证；④项强，脊痛；③风疹，痤疮（E错）。